药物引起的与免疫反应有关的生理功能障碍或组织损伤是
A. 副作用
B. 毒性反应
C. 变态反应
D. 后遗效应
E. 特异质反应

正确答案：C。变态反应

解析：本题考查药物的不良反应。药物引起的与免疫反应有关的生理功能障碍或组织损伤是变态反应（C对）。变态反应是指机体受药物刺激所发生的异常免疫反应，引起机体生理功能障碍或组织损伤，也称过敏反应。副作用（A错）是指在药物按正常用法用量使用时，出现的与治疗目的无关的不适反应。毒性反应（B错）是指在药物剂量过大或体内积蓄过多时发生的危害机体的反应。后遗效应（D错）是指在停药后血药浓度已降至最低有效浓度以下时仍残留的药理效应。特异质反应（E错）是指少数特异体质患者对某些药物反应异常敏感。